传染病监测的内容不包括的选项是
A. 人群免疫水平
B. 基因与遗传因素
C. 病例的三间分布
D. 病原体的型别、耐药性等
E. 动物宿主与媒介昆虫情况

正确答案：B。基因与遗传因素

解析：本题考查传染病监测的内容。传染病监测的内容有：1.及时发现并诊断病例，以便追踪和控制；发现新发传染病或新的公共卫生问题。2.了解病例三间分布情况（C对），及时确定流行或暴发的存在，以便启动暴发调查并控制疫情。3.监测人群免疫水平（A对）、病原体的血清型和（或）基因型、毒力、耐药性（D对）及其变异，以及动物宿主和媒介昆虫的种类、分布、病原体携带状况等（E对），了解疾病的变化趋势，识别高危人群或地区，为干预策略与措施的制定和调整提供信息。4.监测公共卫生干预项目（策略与措施）的进展与效果。基因与遗传因素（B错，为本题正确答案）是分子流行病学的内容。